关于维生素D缺乏性佝偻病的预防措施，不正确的是
A. 及时添加辅食
B. 生后2周即应补充维生素D
C. 提倡母乳喂养
D. 增加户外活动
E. 每日补充维生素D1000IU预防

正确答案：E。每日补充维生素D1000IU预防

解析：治疗和预防本病的关键是每日获得维生素D400IU，用不着1000IU这么大的计量（E错，为本题正确答案）。处于生长高峰期的胎儿，及时的添加辅食可以预防维生素D缺乏性佝偻病（A对）。足月儿生后2周（B对）应开始补充维生素D400IU/d，均补充至2岁。另外母乳中所含钙磷的比例，最适于吸收，所以母乳喂养可以预防维生素D缺乏性佝偻病（C对）。紫外线的照射有利于维生素D的合成，因此孕妇和婴儿适当多晒太阳，多进行户外活动（D对），可以预防维生素D缺乏性佝偻病。